以下有关住宅的基本卫生要求中哪一项是错误的
A. 小气候适宜
B. 采光照明良好
C. 空气清洁卫生
D. 环境安静整洁
E. 卫生间距越大越好

正确答案：E。卫生间距越大越好

解析：本题考查住宅的基本卫生要求。住宅的基本卫生要求有：1.小气候适宜（A对）：室内有适宜的小气候，冬暖夏凉，干燥，防止潮湿，必要时应有通风、采暖、防寒、隔热等设备。2.采光照明良好（B对）：白天充分利用阳光采光，晚间照明适当。3.空气清洁卫生（C对）：应避免室内外各种污染源对室内空气的污染，冬季室内也应有适当的换气。4.隔音性能良好：应避免室外及相邻居室的噪声污染。5.卫生设施齐全：应有上、下水道和其他卫生设施，以保持室内清洁卫生。6.环境安静整洁（D对）：应保证休息、睡眠、学习和工作。卫生间距越大越好（E错，为本题正确答案）不属于住宅的基本卫生要求。